男性，42岁，患急性重症胰腺炎并发休克36小时，经抗休克治疗后行胰腺和其周围坏死组织清除腹腔引流术。术后心率106次/分，血压12.8/8kPa（96/60mmHg），中心静脉压10cmH₂O，呼吸频率22次/分，动脉血氧分压11.5kPa（86mmHg），尿量10ml/小时，尿比重1.002，此病人目前最紧急的并发症是
A. 心功能不全
B. 肺功能衰竭
C. 肾功能衰竭
D. 血容量不足
E. 体内抗利尿激素分泌过多

正确答案：C。肾功能衰竭

解析：患者术后血压96/60mmHg（正常值90～120/60～80mmHg），中心静脉压10cmH₂O（正常值为5～10cmH₂O），有效血容量基本满足机体需要量（D错），且无心功能不全（当中心静脉压＞15cmH₂O时提示心功能不全）（A错）。急性肾衰竭的诊断标准为：尿量＜0.5ml/（kg·h），持续＞6小时，患者成年男性，尿量10ml/小时， 且持续＞6小时（患者急性重症胰腺炎并发休克36小时），符合急性肾功能衰竭（C对）的诊断。肺功能衰竭（B错）诊断标准为动脉血氧分压＜60mmHg，患者虽呼吸稍快，但动脉血氧分压为86mmHg，因此不能诊断为肺功能衰竭。体内抗利尿激素分泌过多（E错）增加远曲小管和集合管上皮细胞对水的通透性，从而影响水的重吸收；增加髓袢升支粗段对NaCl的主动重吸收和内髓部集合管对尿素的通透性，使髓质组织间液溶质增加，渗透浓度提高，利于尿浓缩，尿比重应增高，而该患者的尿比重降低（正常范围1.010～1.020），故可排除。